位于前庭裂平面至声门裂平面之间
A. 喉前庭
B. 喉中间腔
C. 声门下腔
D. 声门裂
E. 前庭裂

正确答案：B。喉中间腔

解析：位于前庭裂平面至声门裂平面之间的是喉中间腔（B对）。